下列哪项不是预包装食品营养标签的基本要求
A. 标示的营养信息应真实、客观
B. 应使用英文
C. 选择适当的营养标签的格式
D. 食品营养成分含量应以具体数值标示
E. 最小销售单元的包装上应有营养标签

正确答案：B。应使用英文